女，58岁。上腹不适、纳差3年，体重减轻、乏力半年。查体：贫血貌，上腹部轻压痛。Hb88g/L，MCV115fl。胃镜检查示胃体皱襞稀疏，黏膜血管透见。该患者发生贫血最可能的机制是
A. 铁利用障碍
B. 慢性消化道失血
C. 蛋白质吸收障碍
D. 维生素C缺乏
E. 内因子缺乏

正确答案：E。内因子缺乏

解析：该患者贫血貌，Hb88g/L（＜90g/L为中度贫血），发生贫血最可能的机制是内因子缺乏（E对）：患者为A型胃炎（自身免疫性胃炎），多累及壁细胞，导致内因子分泌减少，VitB₁₂吸收障碍，发生巨幼细胞性贫血，患者MCV115fl（＞100为大细胞性贫血），符合巨幼细胞性贫血诊断。铁利用障碍（P543）（A错）是铁粒幼细胞性贫血的重要机制。慢性消化道失血（B错）为慢性失血性贫血的常见病因之一，常引起小细胞型贫血。蛋白质吸收障碍（C错）导致营养不良。维生素C缺乏（D错）导致坏血病。